肺功能检查时，阻塞性通气功能障碍最主要的表现是
A. 肺活量降低
B. 残气量增加
C. 气流指数＞1.0
D. 第1秒用力呼气容积降低
E. 肺总量降低

正确答案：D。第1秒用力呼气容积降低

解析：阻塞性通气功能障碍是指气道阻塞引起的通气功能障碍，主要影响小气道，表现为呼气时小气道陷闭，呼气受限，流速下降。肺功能检查时，最主要的表现为第1秒用力呼气容积降低（D对）。阻塞性通气功能障碍肺活量正常或降低（A错），残气量增加（B错），但这都不是最主要的表现。气流指数＞1.0（C错）是限制性通气障碍的肺功能检查结果。